药用部位为内壳的中药材是
A. 石决明
B. 牡蛎
C. 珍珠母
D. 桑螵蛸
E. 海螵蛸

正确答案：E。海螵蛸

解析：本题考查的是海螵蛸的来源。药用部位为内壳的中药材是海螵蛸（E对）。海螵蛸：【来源】为软体动物门乌贼科动物无针乌贼或金乌贼的干燥内壳。石决明（A错）：【来源】为软体动物门鲍科动物杂色鲍（九孔鲍）、皱纹盘鲍、羊鲍、澳洲鲍、耳鲍或白鲍的贝壳。牡蛎（B错）：【来源】为软体动物门牡蛎科动物长牡蛎、大连湾牡蛎或近江牡蛎的贝壳。珍珠母（C错）的药用部位为贝壳。桑螵蛸（D错）：【来源】为节肢动物门昆虫纲螳螂科昆虫大刀螂、小刀螂或巨斧螳螂的干燥卵鞘。